急性尿潴留时最常用的处理方法是
A. 利尿
B. 针灸
C. 膀胱穿刺抽尿
D. 膀胱造瘘
E. 耻骨上穿刺造瘘

正确答案：E。耻骨上穿刺造瘘

解析：尿潴留是指膀胱内充满尿液而不能排出，急性尿潴留的治疗原则是解除病因，恢复排尿，最常用的处理方法是耻骨上穿刺造瘘（E对）。尿潴留属下尿道梗阻症状，利尿（A错）不但不会缓解病情，反而会加重急性尿潴留。针灸（B错）可用于动力性尿潴留，较少使用。膀胱穿刺抽尿（C错）、膀胱造瘘（D错）多用于不能插入导尿管的急性尿潴留病人。